患者，女，19岁，未婚。经来先期，量少，色红，质稠；手足心热，咽干口燥；舌质红，苔少，脉细数。治疗应首选
A. 清经散
B. 丹栀逍遥散
C. 两地汤
D. 固阴煎
E. 归肾丸

正确答案：C。两地汤

解析：题中患者经来先期，故诊断为月经先期。阴虚内热，热扰冲任，冲任不固，经血妄行，故月经提前；阴虚血少，冲任不足，故经血量少；血为热灼，故色红质稠；虚热上浮，故两颧潮红；手足心热，咽干口燥；舌质红，苔少，脉细数均为阴虚内热之征，故辨为阴虚血热证，治宜养阴清热调经。清经散功能清热凉血调经，为治疗月经先期阳盛血热证的选方（A错）。丹栀逍遥散功能疏肝清热，凉血调经，为月经先期肝郁血热证的选方（B错）。月经先期阴虚血热证治宜养阴清热调经，方选两地汤（C对）。固阴煎功能补肾益气，固冲调经，为月经先期肾气虚证的选方（D错）。归肾丸功能滋阴养血，填精益髓，主治肾阴不足，精衰血少证（E错）。